某大型国营公司筹集到一批经费，准备对整个企业职工的职业危害因素接触情况及健康状况进行调查，分析有害因素的接触与人体健康的关系，提出相应的职业危害防护措施。为了保证调查质量，工作中需要特别注意
A. 选用先进仪器设备
B. 做好进度安排
C. 做好宣传
D. 质量控制
E. 及时收集整理资料

正确答案：D。质量控制